关于中药饮片切面特征的说法，正确的有
A. 人参切面淡黄色或类白色，皮部有黄棕色点状油室及放射状裂隙
B. 黄连片切面鲜黄色或红黄色，具有放射状纹理
C. 防己切面灰白色，有稀疏的放射状纹理
D. 天花粉切面白色或淡黄白色，可见黄色小孔，略呈放射状排列
E. 土茯苓切面黄白色或红棕色，可见点状维管束及多数小亮点

正确答案：B、C、D、E。黄连片切面鲜黄色或红黄色，具有放射状纹理；防己切面灰白色，有稀疏的放射状纹理；天花粉切面白色或淡黄白色，可见黄色小孔，略呈放射状排列；土茯苓切面黄白色或红棕色，可见点状维管束及多数小亮点

解析：本题考查中药材的性状鉴别。下列关于饮片断面特征的说法，正确的有黄连片切面鲜黄色或红黄色，具有放射状纹理（B对）、防己切面灰白色，有稀疏的放射状纹理（C对）、天花粉切面白色或淡黄白色，可见黄色小孔，略呈放射状排列（D对）、土茯苓切面黄白色或红棕色，可见点状维管束及多数小亮点（E对）。黄连【性状鉴别】饮片黄连片：呈不规则的薄片，外表皮灰黄色或黄褐色，粗糙，有细小的须根。切面或碎断面鲜黄色或红黄色，具放射状纹理。气微，味极苦。防己【性状鉴别】饮片呈类圆形或半圆形的厚片。外表皮淡灰黄色。切面灰白色，粉性，有稀疏的放射状纹理。气微，味苦。天花粉【性状鉴别】药材：呈不规则圆柱形、纺锤形或瓣块状，长8～16cm，直径1.5～5.5cm。表面黄白色或淡棕黄色，有纵皱纹、细根痕及略凹陷的横长皮孔；有的有黄棕色外皮残留。质坚实，断面白色或淡黄白色，富粉性，横切面可见黄色小孔（导管），略呈放射状排列，纵切面可见黄色条纹状木质部。气微，味微苦。土茯苓【性状鉴别】饮片：呈长圆形或不规则的薄片，边缘不整齐。切面黄白色或红棕色，粉性，可见点状维管束及多数小亮点；以水湿润后有黏滑感。气微，味微甘、涩。人参【性状鉴别】饮片人参片：呈圆形或类圆形薄片。外表皮灰黄色。切面淡黄白色或类白色，显粉性，形成层环纹棕黄色，皮部有黄棕色点状树脂道及放射状裂隙（A错）。体轻，质脆。香气特异，味微苦、甘。